用古蔡法检查砷盐时，所用的试剂有
A. 锌粒
B. 盐酸
C. 碘化钾
D. 氯化亚锡
E. 溴化汞

正确答案：A、B、C、D。锌粒；盐酸；碘化钾；氯化亚锡